保留牙髓坏死或根尖周感染的乳牙最后的治疗手段的是
A. 间接盖髓术
B. 直接盖髓术
C. 氢氧化钙活髓切断术
D. FC（戊二醛）断髓术
E. 根管治疗术

正确答案：E。根管治疗术

解析：根管治疗术：是通过根管预备和药物消毒去除感染物质对根尖周组织的不良刺激，用可吸收的充填材料充填根管，促进根尖周病愈合，是保留牙髓坏死或根尖周感染的乳牙最后的治疗手段。掌握“乳牙牙髓病及根尖周病诊断及治疗”知识点。